关于蜂窝织炎下列哪项不正确
A. 病变组织呈马蜂窝状
B. 皮肤、肌肉和阑尾是好发部位
C. 主要由溶血性链球菌引起
D. 病变弥漫与细菌透明质酸酶和链激酶有关
E. 中性粒细胞弥漫浸润组织

正确答案：A。病变组织呈马蜂窝状

解析：蜂窝织炎是好发于皮肤、肌肉和阑尾（B对）等疏松结缔组织的弥漫性化脓性炎，主要由溶血性链球菌引起（C对），链球菌分泌的透明质酸酶和链激酶可降解透明质酸、溶解纤维素，有易于病变的扩散（D对），主要表现为组织内大量中性粒细胞浸润（E对）。蜂窝织炎的病变组织呈弥漫性扩散，而不是马蜂窝状（A错，为本题正确答案）。